气滞血瘀多与何脏的生理功能异常密切相关
A. 心
B. 肝
C. 脾
D. 肺
E. 肾

正确答案：B。肝

解析：血液的正常循行赖于气的推动和调控。肝气疏泄，畅达气机，气行则血行，因而调畅了血液的运行。若肝气疏泄失常，在气机失调的同时，常见血行异常。如肝气郁结，疏泄失职，可致血行不畅，甚则停滞为瘀，出现月经后期、痛经、闭经、癥积痞块等。（B对）。心（A错）的主要生理机能是主血脉，主藏神。脾（C错）的主要生理功能是主运化与主统血。肺（D错）的生理功能是主气司呼吸，主行水，朝百脉，主治节。肾（E错）的主要生理机能是主藏精，主水，主纳气。肾藏先天之精，主生殖，为人体生命本原。